下列各项，不属淋病特点的是
A. 尿频尿急
B. 尿道刺痛
C. 尿道溢脓
D. 排尿困难
E. 腹股沟淋巴结肿大

正确答案：D。排尿困难

解析：淋病是由淋病双球菌所引起的泌尿生殖系感染的性传播疾病。淋病可出现排尿不适，但尿道不会堵塞，并不会出现排尿困难（D对）。急性淋病有可能因为细菌的刺激而出现尿频尿急（A错）。急性淋病可见尿道口红肿发痒及轻度刺痛，24小时后症状加剧至刺痛或灼热痛（B错）。尿道黏膜上皮发生多数局灶性坏死，产生大量脓性分泌物，故见尿道溢脓（C错）。感染刺激淋巴结故见腹股沟淋巴结肿大（E错）。